下列哪项不是疥疮的临床特点
A. 好发于皮肤皱褶部位
B. 皮损初起为针头大小的丘疹或水疱
C. 幼儿可见于面部及头部
D. 全身遍布抓痕、结痂、黑色斑点和脓疱
E. 轻度瘙痒

正确答案：E。轻度瘙痒

解析：疥疮是由疥虫寄生在人体皮肤引起的一种接触传染性皮肤病。疥疮传染性极强，冬春季多见，皮损好发于皮肤薄嫩和褶皱处，如手指侧、指缝、腕肘关节屈侧、腋窝前缘、女性乳房下、少腹、外阴、腹股沟、大腿内侧等处（A错）。头面部和头皮、掌跖一般不易累及，但婴儿例外（C错）。皮疹初起主要为针头大小的丘疹和水疱（B错）。若不及时治疗，迁延日久则全身遍布抓痕、结痂、黑色斑点，甚脓疱至（D错）。患者常有奇痒，遇热或夜间尤甚，常影响睡眠（E对）。